关于根尖片所示正常影像不正确的是
A. 年轻恒牙髓腔宽大
B. 牙槽骨正常高度应达到牙颈部
C. 上颌磨牙髓腔一般为卵圆形
D. 前牙牙髓腔髓室与根管界限不清呈针状低密度影
E. 牙骨质与牙本质有明显区别

正确答案：E。牙骨质与牙本质有明显区别

解析：本题考查根尖片的特点。牙骨质与牙本质有明显区别（E错，为本题正确答案）不符合关于根尖片所示正常影像。根尖片可见：（1）牙釉质：X线片上影像密度最高，似帽状被覆在冠部牙本质表面；（2）牙本质：矿物质含量较牙釉质少，围绕牙髓构成牙齿主体，X线影像密度较牙釉质稍低；（3）牙骨质：覆盖于牙根表面牙本质上，很薄，在X线片上显示影像与牙本质不易区别；（4）牙髓腔：在X线片上显示为密度低影像，下颌磨牙牙髓腔似H形，上颌磨牙髓腔一般为卵圆形（C对），前牙牙髓腔髓室与根管界限不清呈针状低密度影（D对），年轻恒牙髓腔宽大（A对），老年人髓室较年轻人小，根管亦细，这是随年龄增长有继发性牙本质形成所致；（5）牙槽骨：牙槽骨正常高度应达到牙颈部（B对），在X线片上显示的影像比牙密度稍低。